苯巴比妥服药后次晨出现“宿醉”现象，属于
A. 停药反应
B. 毒性反应
C. 副作用
D. 继发反应
E. 后遗效应

正确答案：E。后遗效应

解析：本题考查后遗效应。苯巴比妥服药后次晨出现“宿醉”现象，属于后遗效应（E对）。后遗效应是指在停药后，血药浓度已降至最小有效浓度以下时残存的药理效应。例如，服用巴比妥类催眠药后，次晨出现的乏力、困倦等“宿醉”现象；长期应用肾上腺皮质激素，可引起肾上腺皮质萎缩，一旦停药，可出现肾上腺皮质功能低下，数月难以恢复。停药反应（A错）是指患者长期应用某种药物，突然停药后出现原有疾病加剧的现象，又称回跃反应或反跳。例如，长期应用β受体阻断药普萘洛尔治疗高血压、心绞痛等，可使β受体密度上调而对内源性去甲肾上腺素能神经递质的敏感性增高，如突然停药，则会出现血压升高或心绞痛发作。毒性反应（B错）是指在药物剂量过大或体内蓄积过多时发生的危害机体的反应。副作用（C错）是指在药物按正常用法用量使用时，出现的与治疗目的无关的不适反应。继发反应（D错）是继发于药物治疗作用之后的不良反应，是治疗剂量下治疗作用本身带来的间接结果。